下列各种复位方法操作不当会发生股骨头骨折的是
A. Allis法
B. Kocher法
C. Biglew法
D. Stimson法
E. Hippocrats法

正确答案：C。Biglew法

解析：Biglew法（C对）用于髋关节脱位，因为此法是利用杠杆原理将股骨头复位，若复位时用力过猛，可引起股骨头骨折。Allis法（A错）是常用于髋关节后脱位的治疗，此法安全简便，不易发生股骨头骨折。Kocher法（B错）、Stimson法（D错）、Hippocrats法（E错）主要用于肩关节的脱位，故其不会引起股骨头骨折。